气管和主支气管
A. 气管位于食管后方
B. 气管于胸骨角平面分为左、右主支气管
C. 气管和支气管软骨环均呈"O"形
D. 左主支气管比右侧者粗短
E. 无

正确答案：B。气管于胸骨角平面分为左、右主支气管

解析：气管位于喉与气管杈之间（A错）。气管在胸骨角平面分叉形成左、右主支气管（B对）。气管软骨呈C形（C错）。右主支气管比左主支气管短而粗（D错）。